由于疾病、损伤或外科手术而导致的关节固定、运动丧失是指
A. 颞下颌关节复发性脱位
B. 颞下颌关节急性前脱位
C. 颞下颌关节急性后脱位
D. 颞下颌关节陈旧性脱位
E. 颞下颌关节强直

正确答案：E。颞下颌关节强直

解析：颞下颌关节强直是指由于疾病、损伤或外科手术而导致的关节固定、运动丧失。掌握“颞下颌关节脱位”知识点。